阳离子交换树酯作为固定相，流动相为
A. 水
B. 甲醇
C. 乙醇
D. 乙酸乙酯
E. 甲醚

正确答案：A。水

解析：本题考查的是离子交换色谱的流动相。阳离子交换树酯作为固定相，流动相为水（A对）。离子交换色谱是利用混合物中各成分解离度差异进行分离的方法。该方法以离子交换树脂为固定相，用水或与水混合的溶剂为流动相，在流动相中存在的离子性成分与树脂进行离子交换反应而被吸附。